可呼吸性粉尘是指直径多大的粉尘
A. ﹥15μm
B. ﹥10μm
C. '=10μm
D. ﹤8μm
E. ﹤5μm

正确答案：E。﹤5μm